医疗卫生机构违反条例规定，公开艾滋病患者信息的，应依照哪项法规予以处罚
A. 执业医师法
B. 艾滋病防治条例
C. 医疗机构管理条例
D. 传染病防治法:
E. 保密法

正确答案：D。传染病防治法: